急性心肌梗死心肌损伤的心电图改变是
A. ST段下移
B. ST段明显上抬，呈弓背向上的单向曲线
C. T波倒置
D. T波高耸
E. 异常深而宽的Q波

正确答案：B。ST段明显上抬，呈弓背向上的单向曲线

解析：急性心肌梗死心肌损伤的心电图改变是ST段明显上抬，呈弓背向上的单向曲线（B对）。异常深而宽的Q波为急性心肌梗死心肌坏死的心电图改变（E错）。ST段下移（A错）、T波倒置（C错）为稳定型心绞痛的心电图表现。T波高耸可见于正常年轻人，胸壁薄者、电解质紊乱者、急性心急缺血超前期（D错）。